临终关怀的道德要求不包含的内容是
A. 认识和理解临终患者
B. 尊重和维护临终患者的权利
C. 满足临终病人的生活需求
D. 同情和关心临终患者的家属
E. 展示人类文明的进步

正确答案：E。展示人类文明的进步

解析：临终关怀的道德要求包含的内容是：1.认识和理解临终病人；2.尊重和维护临终病人的权利；3.满足临终病人的生活需求；4.同情和关心临终患者的家属，不包括E，E属于临床关怀的伦理意义。掌握“临终关怀伦理”知识点。